急性乳腺炎的病因不包括
A. 乳头内陷
B. 乳汁过多
C. 乳管不通
D. 乳房淋巴管阻塞
E. 婴儿吸乳少

正确答案：D。乳房淋巴管阻塞

解析：急性乳腺炎的主要发病原因包括：①乳汁淤积：乳汁是细菌理想的培养基，乳汁淤积将有利于入侵细菌的生长繁殖。乳头内陷（A对）、乳汁过多（B对）、乳管不通（C对）、婴儿吸乳少（E对）均可造成乳汁淤积，诱发急性乳腺炎。②细菌入侵：乳头破损或皲裂，使细菌沿淋巴管入侵是感染的主要途径。当乳房淋巴管不通畅时，淋巴液回流不畅，细菌不易经淋巴管入侵，因此，急性乳腺炎的病因不包括乳房淋巴管阻塞（D错，为本题正确答案）。